男性，41岁。上腹疼痛7小时。伴发热，体温38.5℃，频繁呕吐。查体发现上腹部肌紧张，压痛，无移动性浊音。血白细胞15×10⁹/L。X线检查：膈下未见游离气体。如果病人治疗期间出现上腹部包块，首先考虑的诊断是
A. 腹膜转移癌
B. 粘连肠梗阻
C. 胰腺假性囊肿
D. 胰腺癌
E. 结肠癌

正确答案：C。胰腺假性囊肿

解析：中年男性患者，上腹痛7小时、伴发热、频繁呕吐（急性胰腺炎常见的症状）。查体：上腹部肌紧张、压痛（腹膜刺激征）。血白细胞15×10⁹/L（正常为4～10×10⁹/L，提示有炎症）。X线检查：膈下未见游离气体（排除消化道穿孔）。综合患者的病史、查体、实验室检查，可初步诊断为急性胰腺炎。如果病人治疗期间出现上腹部包块，首先考虑的诊断是胰腺假性囊肿（C对）。胰腺假性囊肿为胰液经由坏死破损的胰管溢出在胰腺周围积聚，被纤维组织包裹形成，常在发病后4周左右出现。患者无相关肿瘤病史，不考虑腹膜转移癌（A错）。胰腺癌（P439）（D错）主要表现为持续、进行性加剧的中上腹痛或持续腰背部剧痛，明显的体重减轻和黄疸。结肠癌（九版外科学P389）（E错）主要表现为排便次数增加、腹泻、便秘、黏液脓血便。粘连肠梗阻（P360）（B错）主要表现为腹痛、呕吐、腹胀、停止排气排便，且X线可见气液平面。